腰椎间盘突出症与腰椎管狭窄症临床症状的主要鉴别点是
A. 有无鞍区感觉障碍
B. 间歇性跛行是否为主要特点
C. 双下肢无力的程度
D. 二便是否障碍
E. 腰痛及下肢放射痛的程度

正确答案：B。间歇性跛行是否为主要特点

解析：腰椎间盘突出症与腰椎管狭窄症临床症状的主要鉴别点是间歇性跛行是否为主要特点（B对），腰椎管狭窄症以神经源性间歇性跛行为主要特点，而腰椎间盘突出症不会出现间歇性跛行。腰椎间盘突出症与梨状肌综合征临床症状的主要鉴别点是有无鞍区感觉障碍（A错）和二便是否障碍（D错），中央型腰椎间盘突出症可压迫马尾神经，出现大小便障碍，鞍区感觉障碍，而梨状肌综合征无这些表现。腰椎间盘突出症与第三腰椎横突综合征的主要鉴别点是腰痛及下肢放射痛的程度（E错）和双下肢无力的程度（C错），第三腰椎横突综合征腰痛程度深，而无下肢放射痛，腰椎间盘突出症因神经受压严重或时间较长会出现肌力下降，双下肢无力程度较高。